男性，重体力劳动工人，腰腿痛，并向左下肢放射，咳嗽喷嚏时加重。检查腰部活动明显受限，并向左倾斜，直腿抬高试验阳性。病程中无低热盗汗消瘦症状。如有小腿及足外侧麻木，足趾跖屈力及跟腱反射弱，病变的节段应考虑是
A. 腰1～2
B. 腰2～3
C. 腰3～4
D. 腰4～5
E. 腰5～骶1

正确答案：E。腰5～骶1

解析：患者男性、重体力劳动工人，腰腿痛，并向左下肢放射（腰椎间盘突出症典型表现），咳嗽喷嚏时加重（坐骨神经痛典型表现），检查腰部活动明显受限，并向左倾斜，直腿抬高试验阳性（腰椎间盘突出症的重要体征），结合患者临床表现，该患者最可能的诊断为腰椎间盘突出症。根据受累神经不同，病人常出现相应的感觉、肌力及反射异常。患者有小腿及足外侧麻木，足趾跖屈力及跟腱反射弱，根据P755腰神经根病变的神经定位图表，可知该患者受累神经为S1，故病变的节段应考虑是腰5～骶1（E对）。腰1～2（A错）病变对应L2受累，表现为大腿前中部感觉减退，髂腰肌肌力减弱。腰2～3（B错）病变对应L3受累，表现为股骨内髁感觉减退，股四头肌肌力减弱，膝反射减弱或消失。腰3～4（C错）病变对应L4受累，表现为内踝感觉减退，足背伸肌肌力减弱。腰4～5（D错）病变对应L5受累，表现为小腿外侧和足背痛触觉减退，拇趾背伸肌力减弱。